脏腑湿热证的共同特点是
A. 黄疸
B. 腹痛
C. 腹泻
D. 舌苔黄腻
E. 头胀重

正确答案：D。舌苔黄腻

解析：黄苔而质腻者，称黄腻苔，主湿热或痰热内蕴，或为食积化腐。故舌苔黄腻为脏腑湿热证共见（D对）。黄疸因湿热内阻，胆汁不循常道，泛溢肌肤所致，故为肝胆湿热证所见（A错）。腹痛，因湿热侵袭大肠，胶结不解，壅阻气机所致，故为大肠湿热证所见（B错）。大肠湿热证，因湿热侵犯大肠，津为热迫而下注，故可见腹泻且下黄色稀水便（C错）。头胀重，多因痰湿内阻，清阳不升所致（E错）。